混合痔的手术方法是
A. 药物注射
B. 外剥内扎术
C. 缝合结扎
D. 冷冻、激光
E. 结扎熏洗

正确答案：B。外剥内扎术

解析：外剥内扎术（B对）适应证：混合痔。药物注射（A错）适应证：Ⅰ、Ⅱ、Ⅲ期内痔，内痔兼有贫血者，混合痔的内痔部分。结扎疗法（CE错）适应证：Ⅱ-Ⅳ期内痔，对纤维型内痔更为适宜。冷冻、激光（D错）主要适应证为Ⅰ、Ⅱ、Ⅲ期内痔。